男，69岁。刺激性咳嗽1个月，发现痰中带血丝1周。无肺部疾病病史，吸烟20年。该患者最可能的诊断是
A. 肺癌
B. 支气管扩张
C. 肺结核
D. 急性支气管炎
E. 肺脓肿

正确答案：A。肺癌

解析：患者为老年男性（为肺癌的好发年龄），有20年的吸烟史（为肺癌的重要原因），刺激性咳嗽，并痰中带血（为肺癌的典型临床表现），且无肺部疾病病史，根据其临床表现和体征，首先考虑为肺癌（A对）。支气管扩张（P37）（B错）主要表现为反复的咳嗽、咳痰或咳脓痰，不符合该患者的表现。肺结核（P65）（C错）主要表现为咳嗽、咳痰、咯血、胸痛及呼吸困难，且有低热、盗汗等结核杆菌感染征象，不符合该患者的表现。急性支气管炎（P17）（D错）咳嗽、咳痰，两肺闻及散在干、湿性啰音，不符合该患者的表现。肺脓肿（P58）（E错）主要表现为发热、咳痰、咳大量脓臭痰，不符合该患者的表现。